以下不属于环境消毒的是
A. 空气消毒
B. 个人消毒
C. 地面消毒
D. 墙面消毒
E. 表面消毒

正确答案：B。个人消毒

解析：环境消毒包括：空气消毒、地面消毒、墙面消毒、其他表面消毒。其他表面消毒：包括病历夹、门把手、水龙头、门窗、洗手池、卫生间、便池等物体表面，这些地方容易受到污染。通常情况下，每天用洁净水擦抹刷洗处理，保持清洁。掌握“患者、医务人员及环境的防护”知识点。